碱性环境可增加其抗菌活性的药物是
A. 磺胺嘧啶
B. 链霉素
C. 红霉素
D. 苯巴比妥
E. 水杨酸钠

正确答案：B。链霉素